中毒型菌痢的基本病理生理改变是
A. 微循环障碍
B. 脑水肿颅内高压
C. 严重腹泻导致脱水
D. 代谢性酸中毒
E. 电解质严重紊乱

正确答案：A。微循环障碍

解析：志贺菌裂解释放的内毒素入血后，引起发热和毒血症，并可释放各种血管活性物质，引起急性微循环衰竭（A对），进而引起感染性休克、DIC 及重要脏器功能衰竭，临床表现为中毒性菌痢（休克型）。